石瘿的首选治法是
A. 内治
B. 外治
C. 针灸
D. 手术
E. 熏法

正确答案：D。手术

解析：石瘿，临床特点为结喉两侧结块，坚硬如石，高低不平，推之不移，好发于40岁以上的中年然，相当于西医的甲状腺癌。石瘿一旦确诊，宜早期手术切除，以求根治。但未分化癌不宜手术切除，手术可加速癌细胞的扩散，治疗以放射疗法为主（D对）。内治和外治为本病治疗的辅助方法（AB错）。针灸和熏法不是本病的治疗方法（CE错）。